附睾结核多继发于
A. 肾结核
B. 骨结核
C. 淋巴结核
D. 肠结核
E. 肺结核

正确答案：A。肾结核

解析：附睾结核是临床上最常见的男性生殖系统结核，多继发于肾结核（A对）。